咽结合膜热中的病原体主要是
A. 腺病毒
B. 柯萨奇病毒A
C. 柯萨奇病毒B
D. 埃可病毒
E. 单纯疱疹病毒

正确答案：A。腺病毒

解析：咽结合膜热的主要病原体为腺病毒3、7型。掌握“急性上呼吸道感染”知识点。